中国是全球结核病第二个高负担国家，结核病的患病率和死亡率都比较高。20多年来，中国政府通过接受两期世界银行贷款、英国政府、WHO等双边和多边卫生援助项目，在西部省份特别是偏远地区开展了大规模的结核病控制项目。这一行动体现了中国政府的社会卫生策略是
A. 预防为主
B. 中西医并重
C. 以农村为重点
D. 依靠科学技术
E. 动员全社会参与

正确答案：C。以农村为重点